有助于肾小球肾炎诊断的检查是
A. 尿细菌培养加药物敏感试验
B. 尿红细胞形态分析
C. 尿脱落细胞检查
D. 尿道分泌物涂片
E. 尿液成分分析

正确答案：B。尿红细胞形态分析

解析：尿红细胞形态分析（B对）可以通过红细胞的形态来区分血尿的来源，其中变形红细胞尿为肾小球源性，是肾小球肾炎的表现之一，有助于诊断；均一形态正常红细胞尿则为非肾小球源性，红细胞来自肾小球之后的组织，没有经过肾小球滤过膜的挤压变形。尿细菌培养加药物敏感试验（P494）（A错）可用于辅助诊断尿路感染和指导临床抗感染用药。